治疗胃热呕逆，宜选用
A. 栀子
B. 知母
C. 芦根
D. 天花粉
E. 夏枯草

正确答案：C。芦根

解析：芦根甘寒质轻，主以清利，兼以透散，入肺、胃经。既能清肺胃热而生津除烦、止呕，又能利小便而导湿热之邪从前阴出，还兼透散表邪。虽药力平和，但不滋腻，不恋邪，且味不苦而易服。主治热病烦渴、肺热咳嗽，肺痈吐脓、胃热呕哕、热淋涩痛。（C对）。栀子（A错）苦寒降泄清利，善清心、肺、三焦之火，导湿热之邪从小便而出。入气分能泻火而除烦，入血分能凉血解毒而止血疗疮，入三焦能清利湿热而利尿退黄。此外，外用还具消肿止痛之功。知母（B错）苦寒清泄，甘而滋润，清热之力虽稍逊石膏，但却擅长滋阴润燥。善清上中下三焦之热而滋润，上能清肺润燥，中能清胃生津，下能滋阴降火，有良好的清热泻火、滋阴润燥之功。天花粉（D错）苦寒清泄，微甘而润，且兼行散，入肺、胃经，为清润消肿排脓之品。既善清肺胃之热而生津液、润肺燥，又能消肿痛、排疮脓而疗疮治伤。夏枯草（E错）苦辛而寒，专入肝胆，主清泄散郁，略益血养肝。既善清肝火而明目，又善散郁结而消肿，为治肝阳眩晕、目珠夜痛及瘰疬肿结之要药。